女性，22岁，因全口牙龈肿痛，伴自发性出血来诊。检查患者口腔卫生差，牙石软垢Ⅲ度，口臭明显。全口牙龈红肿，左右下12唇侧牙龈乳头呈刀削状，表面有灰白色伪膜被覆，去除坏死膜，基底为易出血的新鲜创面。该病例拟诊断为
A. 急性感染性口炎
B. 放射性口腔炎
C. 坏死性龈口炎
D. 疱疹性龈口炎
E. 白血病

正确答案：C。坏死性龈口炎

解析：本题考查坏死性龈口炎的临床表现。女性，22岁，因全口牙龈肿痛，伴自发性出血来诊。检查患者口腔卫生差，牙石软垢Ⅲ度，口臭明显。全口牙龈红肿，左右下12唇侧牙龈乳头呈刀削状，表面有灰白色伪膜被覆，去除坏死膜，基底为易出血的新鲜创面。该病例拟诊断为坏死性龈口炎（C对）。该患者口臭明显，全口牙龈红肿，左右下12唇侧牙龈乳头呈刀削状，表面有灰白色伪膜被覆，去除坏死膜，基底为易出血的新鲜创面，这是典型的坏死性龈口炎的临床表现，应诊断为此病。放射性口炎（B错）是放射线电离辐射引起的急慢性口腔黏膜损伤，临床常见于头颈部肿瘤接受放射治疗的患者，表现为黏膜充血明显，依次出现糜烂、溃疡，覆盖白色假膜，易出血，触痛明显，该患者无放射治疗史。疱疹性龈口炎（D错）以出现簇集性小水泡为特征，可融合为大疱，破溃、糜烂，表面覆盖假膜，而该患者未出现典型的小水泡病损。白血病（E错）患者主要表现为牙龈的自发性出血，全口性牙龈增生肿大，波及边缘龈、龈乳头和附着龈，外形不规则，呈结节状，表面光亮，也有组织坏死、溃疡、假膜和口臭，与该患者牙龈呈刀削状不符。